影响振动不良作用的重要外界条件是
A. 潮湿
B. 高温
C. 寒冷
D. 热辐射
E. 以上都是

正确答案：C。寒冷

解析：本题考查影响振动不良反应的外界条件。环境温度和湿度是影响振动危害的重要因素，低气温、高气湿可以加速手臂振动病的发生和发展，尤其全身受冷（C对ABDE错）是诱发VWF的重要条件。所以手臂振动病多发生在寒冷地区和寒冷季节。